下列哪项不是慢性肾功能衰竭时能见到的尿液变化
A. 多尿
B. 高渗尿
C. 等渗尿
D. 夜尿
E. 蛋白尿

正确答案：B。高渗尿

解析：慢性肾功能衰竭时能见到的尿液变化包括：1. 尿量的改变，(1)夜尿（D对）(2) 多尿（A对）(3)少尿；2. 尿渗透压的变化，(1)低渗尿（B错，为本题正确答案）(2) 等渗尿（C对）；3. 尿成分的变化，(1)蛋白尿（E对）(2)血尿(3 ) 管型尿。